女，40岁，间断咳嗽咳痰15年，活动时气短5年，间断双下肢水肿2年。查体颈静脉充盈，双肺呼吸音减轻，心率90次/分，节律齐，P₂＞A₂，三尖瓣听诊区可闻及2/6级收缩期杂音，诊断
A. 风湿性心脏瓣膜病
B. 房室间隔缺损
C. 缩窄性心包炎
D. 慢性肺源性心脏病
E. 慢性血栓性肺动脉高压

正确答案：D。慢性肺源性心脏病

解析：该患者女，40岁，出现间断咳嗽咳痰15年，活动时气短5年，间断双下肢水肿2年（慢性肺源性心脏病的表现）。查体颈静脉充盈，双肺呼吸音减轻，心率90次/分，节律齐，P₂＞A₂，三尖瓣听诊区可闻及2/6级收缩期杂音（慢性肺源性心脏病的体征），结合患者的表现和体征，诊断为慢性肺源性心脏病（D对）。合并关闭不全和二尖瓣病变者多为风湿性心脏瓣膜病（A错）。“小型室间隔缺损可无异常征象；中型室间隔缺损可见肺血增加，心影略向左增大；大型室间隔缺损主要表现为肺动脉及其主要分支明显扩张，但在肺野外 1/3 血管影突然减少，心影大小不一”（B错）。“缩窄性心包炎病人常有心包炎、心包积液、恶性肿瘤、胸部放射性治疗和胸心外科手术等病史。部分病人起病隐匿，早期无明显临床症状。主要症状与心输出量下降和体循环淤血有关，表现为心悸、劳力性呼吸困难、活动耐量下降、疲乏以及肝大、腹腔积液、胸腔积液、下肢水肿等（C错）。慢性血栓栓塞性肺动脉高压是急性肺栓塞或肺动脉原位血栓形成的长期后果（E错）。